与水共研则产生苯甲醛特殊香气的药材是
A. 葶苈子
B. 补骨脂
C. 巴豆
D. 苦杏仁
E. 马钱子

正确答案：D。苦杏仁

解析：本题考查的是苦杏仁的成分。与水共研则产生苯甲醛特殊香气的药材是苦杏仁（D对）。苦杏仁苷是一种氰苷，易被酸和酶所催化水解。水解所得到的苷元α-羟基苯乙腈很不稳定，易分解生成苯甲醛和氢氰酸。其中苯甲醛具有特殊的香味。通常将此作为鉴别苦杏仁苷的方法。葶苈子（A错）【成分】北葶苈子含芥子苷，脂肪油，蛋白质，糖类，生物碱，挥发油及强心成分。南葶苈子含挥发油，油中含异硫氰酸苄酯60%、异硫氰酸烯丙酯、丁烯腈、双硫烯丙基12.5%。补骨脂（B错）【成分】含挥发油、香豆素、黄酮类、单萜酚、脂类化合物、树脂及豆甾醇等。巴豆（C错）【成分】种仁含脂肪油（巴豆油）34%～57%，蛋白质约18%。巴豆油中含巴豆树脂，系巴豆醇、甲酸、丁酸及巴豆油酸结合而成的酯，有强烈的致泻作用。马钱子（E错）【成分】马钱种子含总生物碱2%～5%，主要为番木鳖碱（士的宁），异番木鳖碱，马钱子碱，另含微量的番木鳖次碱、伪番木鳖碱、伪马钱子碱、异马钱子碱等。